女，48岁。近1个月来出现口渴。每日饮水量约2000ｍl。身高156cm，体重70kg。患者空腹血糖180mg/dL(10.0mmol/L），餐后血糖252mg/dL(14.0mmol/L），过去无糖尿病病史。【假设信息】4年后该患者被发现有浸润性肺结核，降血糖治疗宜选用
A. 增加原降血糖药剂量
B. 改用降血糖作用更强的口服降血糖药
C. 增加一种口服降血糖药
D. 使用胰岛素
E. 联合使用双胍类、磺脲类、α-葡萄糖苷酶抑制剂

正确答案：D。使用胰岛素

解析：患者女，48岁。近1个月来出现口渴。身高156cm，体重70kg。患者空腹血糖180mg/dL(10.0mmol/L），餐后血糖252mg/dL(14.0mmol/L），过去无糖尿病病史，诊断为2型糖尿病，4年后该患者被发现有浸润性肺结核，属于糖尿病合并感染，此时降血糖治疗宜选用胰岛素（D对）。